环境质量评价的目的不包括
A. 较全面揭示区域环境质量状况及其变化趋势
B. 确定污染治理重点对象
C. 为确定区域规划和制定区域环境综合防治方案提供依据
D. 为企业更好的生产提供依据
E. 预测和评价拟建的建设项目对周围环境可能产生的影响

正确答案：D。为企业更好的生产提供依据